对局限型侵袭性牙周炎的疗效超过单独外科治疗的是
A. 麝香草酚
B. 氯己定
C. 四环素
D. 磺胺类
E. 甲硝唑

正确答案：C。四环素

解析：四环素族药物为广谱抗生素。对G+菌、G-菌及螺旋体均有抑制其繁殖的作用，对多种牙周可疑致病菌都有抑制作用，尤其是对伴放线放线杆菌（Aa）具有较强的抑制作用，对侵袭性牙周炎有较好的临床疗效。掌握“慢性牙周炎的治疗原则、程序及方法”知识点。